胸膜斑指压度＞5mm的局限性胸膜增厚，镜下可见由玻璃样变的粗大胶原纤维束构成。它系下列哪类病患的特征性病变
A. 石棉肺
B. 矽肺
C. 煤肺
D. 煤矽肺
E. 尘肺

正确答案：A。石棉肺